1986年以来，我国已有百余所医院定期上报、反馈医院内感染与病原菌耐药的信息，这属于流行病学研究中的
A. 生态学研究
B. 疾病监测
C. 描述性研究
D. 病例对照研究
E. 实验流行病学

正确答案：B。疾病监测